肺循环起、止于
A. 左心房→左心室
B. 右心房→右心室
C. 右心室→左心房
D. 左心室→右心房
E. 主动脉→肺动脉

正确答案：C。右心室→左心房

解析：起自右心室止于左心房（C对）的循环途径为肺循环。体循环和肺循环同时进行， 肺循环路程较短，只通过肺，主要使静脉血转变成氧饱和的动脉血。